女孩，3岁。高热、咽痛、纳差3天。查体：咽部充血，眼结膜充血，颈部、耳后淋巴结肿大。心肺无异常。最可能的病原体是
A. 副流感病毒
B. 腺病毒
C. 单纯疱疹病毒
D. 柯萨奇病毒
E. 流感病毒

正确答案：B。腺病毒

解析：患儿，高热纳差，并有咽部充血、眼结膜充血、颈部耳后淋巴结肿大的临床表现，应诊断为咽结合膜热。导致咽结合膜热的病原体是腺病毒（B对）。流感病毒（A错）和副流感病毒（E错）是引起流行性感冒的病原体。单纯疱疹病毒是儿童心肌炎的病原体（C错）。柯萨奇病毒是手足口病的病原体（D错）。